生态学研究属于
A. 描述性研究
B. 分析性研究
C. 实验性研究
D. 理论与方法学研究
E. 统计分析法

正确答案：A。描述性研究

解析：本题考查生态学研究的概念。生态学研究又称相关性研究，是描述性研究（A对BCDE错）的一种类型，它是在群体的水平上研究某种暴露因素与疾病之间的关系，以群体为观察和分析的单位，通过描述不同人群中某因素的暴露状况与疾病的频率，分析该暴露因素与疾病之间的关系。